决定某种外源化学物对机体损害作用的最重要因素是
A. 毒物种类
B. 接触剂量
C. 进入途径和方式
D. 接触时间
E. 物种与个体差异

正确答案：B。接触剂量